AFB₁在体内脱甲基后的代谢产物是
A. AFM₁
B. AFK₁
C. AFP₁
D. AFH₁
E. AFQ₁

正确答案：C。AFP₁